逆温增多发生在
A. 天气晴朗的日子
B. 春夏之交的白天
C. 夏夜
D. 秋冬之交的白天
E. 冬夜

正确答案：E。冬夜

解析：本题考查逆温增多。逆温增多是由于地表发射的热量和大气中的热量辐射的不均衡所导致的。在白天，地表发射的热量大于大气中的热量辐射，因此温度会下降；而在夜晚，地表发射的热量小于大气中的热量辐射，因此温度会上升。因此，逆温增多发生在冬夜（E对ABCD错）。